三期梅毒的主要表现为
A. 疳疮硬下疳
B. 杨梅疮
C. 横痃
D. 小儿遗毒胎传梅毒
E. 杨梅结毒

正确答案：E。杨梅结毒

解析：杨梅结毒为杨梅疮证之晚期，梅毒侵于骨髓，关节，或流窜脏腑，所以是三期梅毒的主要表现（E对）。一期梅毒出现疳疮硬下疳（A错）。因感染梅毒而引致的一种全身性疾病，先出现下疳，或见有横痃，继则发杨梅疮（B错）。一期梅毒出现横痃，即腹股沟淋巴结肿大（C错）。小儿遗毒胎传梅毒早期病变较后天梅毒为重，晚期较轻，心血管受累少，骨骼、感官系统如眼、耳、鼻受累多见（D错）。